某化工厂因意外事故出现氮氧化合物泄漏，造成楼下居民咳嗽、胸闷、面色发红，治疗转运过程中，最应该预防居民出现的意外是
A. 窒息
B. 肺气肿
C. 休克
D. 急性中毒性肺水肿
E. 硅肺

正确答案：D。急性中毒性肺水肿

解析：楼下居民咳嗽、胸闷、面色发红，最应该预防居民出现的意外是急性中毒性肺水肿，氮氧化物NO为扩血管物质导致渗出增多从而导致肺水肿（D对）。